慢性阻塞性肺病急性加重期伴脓痰者宜选用的治疗方案是
A. 长效β₂受体激动剂+吸入型糖皮质激素
B. 吸入型糖皮质激素+磷酸二脂酶抑制剂
C. 抗菌药物+短效支气管舒张剂+糖皮质激素
D. 吸入型糖皮质激素+镇咳药+抗过敏药
E. 吸入型糖皮质激素+祛痰药+镇咳药

正确答案：C。抗菌药物+短效支气管舒张剂+糖皮质激素

解析：本题考查慢性阻塞性肺疾病用药。慢性阻塞性肺病急性加重期伴脓痰者宜选用的治疗方案是抗菌药物+短效支气管舒张剂+糖皮质激素（C对）。慢性阻塞性肺疾病急性加重期可针对性使用抗菌药物，并首选短效支气管舒张剂吸入或茶碱类静脉应用，必要时可短期加用糖皮质激素，口服或静脉使用；促进排痰，加强营养支持，保持大便通畅。伴脓痰者说明有细菌感染，需配合使用抗菌药物。长效β₂受体激动剂+吸入型糖皮质激素（A错）是慢性阻塞性肺病稳定期患者（FEV1＜50%）宜选用的治疗方案。